不属于化学性控制菌斑制剂的是
A. 洗必泰
B. 酚类化合物
C. 季铵化合物
D. 三氯羟苯醚
E. 甲基丙烯酸甲脂

正确答案：E。甲基丙烯酸甲脂

解析：常用的控制菌斑化学制剂：①氯己定；②酚类化合物；③季铵化合物；④氟化亚锡；⑤三氯羟苯醚。甲基丙烯酸甲脂为窝沟封闭的稀释剂。掌握“菌斑控制及提高宿主抵抗力”知识点。